女性，28岁。停经55天，伴恶心呕吐，妇科检查：子宫增大约妊娠50天，双侧附件（-）。该病例首选辅助检查是
A. B超
B. 基础体温测定
C. 宫颈黏液检查
D. 血hCG检查
E. 黄体酮试验

正确答案：A。B超

解析：青年女性，停经55天，伴恶心呕吐（早期妊娠主要表现为停经、早孕反应），子宫增大约妊娠50天（子宫增大程度与停经周数相符），故考虑早期妊娠。B超（A对）检查是早期妊娠的首选辅助检查，其可确定宫内妊娠，排除异位妊娠和滋养细胞疾病，估计孕龄，排除盆腔肿块或子宫异常等。基础体温测定（P43）（B错）出现高温相18日提示早孕的可能性大；宫颈黏液检查（P42）（C错）可以见到排列成行的珠豆状椭圆体，这种结晶可见于妊娠期，但也可见于黄体期；血hCG检测（P34）（D错）是诊断早孕的最敏感方法，于受精后10日即可检测出，但需排除妊娠滋养细胞疾病，三者均不能独立作为确诊早期妊娠的依据，不是首选辅助检查。黄体酮试验即孕激素试验（P355）（E错）用于鉴别首选辅助检查闭经的原因。